工业废水的处理按照处理程度分为三级处理，其中二级处理是为了去除
A. 水中无机化合物
B. 水中有机污染物
C. 水中悬浮性固体杂质
D. 水中的胶体物质
E. 水中的重金属

正确答案：B。水中有机污染物

解析：本题考查工业废水的处理。工业废水的二级处理是为了去除水中的有机污染物（B对ACDE错）。有机污染物是指含有碳和氢的有机化合物，它们可以来自工业废水中的有机溶剂、油污、污泥、污水等。